正常情况下唾液分泌量每分钟为
A. 0.5ml
B. 0.75ml
C. 0.85ml
D. 1.0ml
E. 1.5ml

正确答案：A。0.5ml

解析：本题考查唾液的分泌。正常情况下唾液分泌量每分钟为0.5ml（A对）。正常成人每天的唾液分泌量为1000～1500mL，其中的绝大多数来自三对大唾液腺。在无任何刺激的情况下，唾液的基础分泌为每分钟0.5mL。下颌下腺静止时分泌量最大，占60%～65%；腮腺占22%～30%，但对于进食等刺激的反应大于下颌下腺；舌下腺约占2%～4%；小唾液腺约占7%～8%。